患者，男性，65岁。COPD急性发作伴发热。使用头孢他啶10天，体温曾降至正常，症状缓解3天后再次出现发热，检查发现口腔黏膜有白色念珠菌感染，此时抗生素拟改用
A. 红霉素
B. 氯霉素
C. 青霉素
D. 两性霉素B
E. 环丙沙星

正确答案：D。两性霉素B

解析：患者为老年男性，有基础病COPD，最近COPD急性发作，使用抗生素类药物后再次出现发热，且发现口腔黏膜有白色念珠菌感染（为念珠菌感染的典型表现），根据其临床表现和体征，患者考虑诊断为肺念珠菌病。病情严重者应及时应用抗真菌药物，氟康唑、伊曲康唑、伏立康唑和泊沙康唑均有效果，两性霉素B亦可用于重症病例（D对）。红霉素（A错）属于大环内酯类抗生素，用于治疗耐青霉素的金黄色葡萄球菌感染和对青霉素过敏者。氯霉素（B错）是治疗伤寒，副伤寒的首选药。青霉素（C错）适用于A组及B组溶血性链球菌、肺炎链球菌、对青霉素敏感金葡菌等革兰阳性球菌所致的各种感染。环丙沙星（E错）为合成的第三代喹诺酮类抗菌药物，具有广谱抗菌活性，对肠杆菌、绿脓杆菌、流感嗜血杆菌、淋球菌、链球菌、军团菌、金黄色葡萄球菌具有抗菌作用，对白色念珠菌无效。